卫生学评价中表示声音强度大小的单位最常用的为
A. 声频带
B. 声频
C. 声压级
D. 声功率级
E. 声强级

正确答案：C。声压级